4岁女孩，发热咳嗽5天，呕吐2天，抽搐2次，查体，体温40度，双肺闻及湿啰音，前囟膨隆，颈软，双侧巴氏征（+），脑脊液检查，浑浊，白细胞800×106/L，N：0.8，L：0.2。蛋白质2/L，葡萄糖1.2mol/L，氯化物108mmol/L。除了为肺炎外还诊断为
A. 中毒性脑膜炎
B. 结核性脑膜炎
C. 化脓性脑膜炎
D. 病毒性脑炎
E. 热性惊厥

正确答案：C。化脓性脑膜炎

解析：患儿，有发热、抽搐、呕吐、前囟饱满、颅内压增高的临床表现，并且脑脊液检查可见白细胞800×10⁶/L（增高），中性粒细胞为主，糖1.2mmol/L（降低），氯化物108mmol/L（降低），蛋白质2g/L（明显增高），因此该患儿最可能诊断的是化脓性脑膜炎（C对）。病毒性脑膜炎（A错）、热性惊厥（E错）病毒性脑病（D错）的脑脊液检查氯化物和糖都正常（而该患儿降低）。结核性脑膜炎白细胞以淋巴细胞增高为主，而不是以中性粒细胞增高为主（B错）。